在高血压的检出方案中，血压筛选水平甲定在高压160mmHg，乙定在高压140mmHg，这意味着
A. 甲试验的灵敏度比乙试验高
B. 甲试验的特异度比乙试验高
C. 甲试验的假阳性数比乙试验多
D. 甲试验的阳性预测值比乙试验低
E. 甲试验的假阴性数比乙试验少

正确答案：B。甲试验的特异度比乙试验高